柴胡中主要化学成分的结构类型是
A. 蒽醌类
B. 皂苷类
C. 生物碱类
D. 黄酮类
E. 木脂素类

正确答案：B。皂苷类

解析：本题考查的是柴胡的化学成分。柴胡中主要化学成分的结构类型是皂苷类（B对）。柴胡中含有的总皂苷为1.6%～3.8%。柴胡中所含皂苷均为三萜皂苷，柴胡皂苷是柴胡的主要有效成分。《中国药典》以柴胡皂苷a和柴胡皂苷d为指标成分对柴胡药材进行含量测定。要求两者的总含量不少于0.30%。含蒽醌类（A错）成分的中药有大黄、虎杖、何首乌、芦荟、决明子等。生物碱类（C错）主要分布于植物界，在动物界中少有发现。生物碱绝大多数存在于双子叶植物中，已知有50多个科的120多个属中存在生物碱。与中药有关的典型的科有毛茛科（黄连属黄连，乌头属乌头、附子）、防己科（汉防己、北豆根）、罂粟科（罂粟、延胡索）、茄科（曼陀罗属洋金花、颠茄属颠茄、莨菪属莨菪）、马钱科（马钱子）、小檗科（三颗针）、豆科（苦参属苦参、槐属苦豆子）等。单子叶植物也有少数科属存在生物碱，如石蒜科、百合科（贝母属的川贝母、浙贝母）、兰科等。少数裸子植物如麻黄科、红豆杉科、三尖杉科和松柏科也存在生物碱。低等植物中仅发现极个别的存在生物碱，如烟碱存在于蕨类植物中，麦角生物碱存在于菌类植物中。地衣、苔藓类植物中仅发现少数简单的吲哚类生物碱。藻类、水生类植物中未发现生物碱。黄酮类（D错）化合物广泛存在于自然界中，多存在于高等植物及羊齿类植物中。苔类中含有的黄酮类化合物为数不多，而藻类、霉菌、细菌中没有发现黄酮类化合物。含黄酮类化合物的中药有黄芩、葛根、银杏叶、槐花、陈皮、满山红等。含木脂素类（E错）中药有五味子、厚朴、连翘、细辛等。